患者，女，64岁，患2型糖尿病、高脂血症，给予二甲双胍肠溶片0.5gtidpo、瑞格列奈片1mgtidpo、阿托伐他汀钙片20mgtidpo等药物治疗。药师对患者的用药指导，错误的是
A. 二甲双胍肠溶片应于餐后服用
B. 瑞格列奈片应于餐前服用
C. 阿托伐他汀钙片可在一天中任何时候固定时间给药
D. 一旦出现低血糖症状，应立即口服葡萄糖水、糖块、巧克力等
E. 用药期间应注意监测肝肾功能

正确答案：A。二甲双胍肠溶片应于餐后服用

解析：本题考查药品服用的适宜时间。二甲双胍对胃肠道有刺激性，应于餐中服用（A错，为本题的正确答案）。瑞格列奈片宜于餐前服用（B对）。阿托伐他汀钙片和瑞舒伐他汀片可在一天中任何时候固定时间给药（C对）。糖尿病患者服药期间一旦出现低血糖症状，应立即口服葡萄糖水、糖块、巧克力等（D对）。用药期间应注意监测肝肾功能（E对）。